男，45岁。因急性坏疽性阑尾炎行阑尾切除术后第10天，出现发热，体温39.2℃。伴腹胀、恶心，肛门有下坠感，里急后重，曾排便4次，为黏液样便。此时首先应选用的检查是
A. 腹部X线平片
B. 粪培养
C. 血常规
D. 腹部B超
E. 直肠指检

正确答案：E。直肠指检

解析：患者男，急性坏疽性阑尾炎行阑尾切除术后第10天，出现发热，肛门有下坠感，里急后重，提示盆腔脓肿。直肠指检（E对）较为简便，可作为首选的检查，若发现肛管括约肌松弛，在直肠前壁可触及向肠腔内膨起、有触痛、有时有波动感的肿物，则可初步诊断为盆腔脓肿，下腹部超声及经直肠或阴道超声检查可作为进一步诊断的检查方法（D错）；腹部X线平片一般不作为诊断盆腔脓肿的检查（A错），粪培养一般无异常（B错），血常规可出现白细胞计数增高，但缺乏特异性（C错）。